急性肾小球肾炎的主要临床特征是
A. 少尿，浮肿，蛋白尿
B. 血尿，蛋白尿
C. 浮肿，蛋白尿，血尿，高血压
D. 血尿，少尿，蛋白尿，浮肿
E. 浮肿，大量蛋白尿，低蛋白血症

正确答案：C。浮肿，蛋白尿，血尿，高血压

解析：急性肾小球肾炎简称急性肾炎，以急性起病，不同程度的血尿、蛋白尿、水肿、高血压、少尿及一过性氮质血症为常见的临床表现（C对）。少尿，浮肿，蛋白尿表现可见于急性肾小球肾炎，血尿常为急性肾小球肾炎起病的首发症状，几乎所有患者都有血尿（A错）。急性肾小球肾炎有血尿，蛋白尿症状，但又有水肿、高血压等体征（B错）。急性肾小球肾炎有血尿，少尿，蛋白尿，浮肿症状，但又有高血压体征，见于80%左右的病例（D错）。肾病综合征的临床特征为大量蛋白尿，低蛋白血症，水肿，高脂血症（E错）。